具有协同增效作用的中西药联用药组有
A. 甘草与呋喃唑酮联用治疗肾盂肾炎
B. 黄连、黄柏与磺胺甲基异唑联用治疗痢疾
C. 甘草与氢化可的松联用于抗炎
D. 丹参注射液与间羟胺联用于升压
E. 柴胡桂枝汤与苯妥英钠联用治疗癫痫

正确答案：B、C、D。黄连、黄柏与磺胺甲基异唑联用治疗痢疾；甘草与氢化可的松联用于抗炎；丹参注射液与间羟胺联用于升压

解析：本题考查的是中西药联用的特点。具有协同增效作用的中西药联用药组有黄连、黄柏与磺胺甲基异唑联用治疗痢疾（B对）、甘草与氢化可的松联用于抗炎（C对）与丹参注射液与间羟胺联用于升压（D对）。中西药联用协同增效：许多中西药联用后，常能使疗效提高，呈现药物之间的协同作用，如黄连、黄柏与四环素、呋喃唑酮（痢特灵）、磺胺甲基异噁唑，治疗痢疾、细菌性腹泻有协同作用，常使疗效成倍提高。金银花能加强青霉素对耐药性金黄色葡萄球菌的杀菌作用。枳实能松弛胆括约肌，有利于庆大霉素进入胆道，提高后者的抗感染作用。丙谷胺与甘草、白芍、冰片联合治疗消化性溃疡，有协同作用，现已制成复方丙谷胺（胃丙胺）。甘草与氢化可的松在抗炎、抗变态反应方面有协同作用，因甘草甜素有糖皮质激素样作用，并可抑制氢化可的松在体内的代谢灭活，使其在血液中浓度升高。具有保护肝脏和利胆作用的茵陈蒿汤、大柴胡汤等与西药利胆药联用，能相互增强消炎利胆的作用。针对幽门螺杆菌的根除治疗，参苓白术散和补中益气方与西药三联或四联疗法同时使用，具有协同增效作用。小青龙汤联合激素治疗小儿轻中度急性哮喘有良好的协同作用，用药无明显不良反应，对中医证候及肺功能的改善优于单一西药治疗，其机制考虑与增强患儿免疫力有关。丹参注射液、黄芪注射液、川芎嗪注射液等与低分子右旋糖酐、能量合剂等同用，可提高心肌梗死的抢救成功率。丹参注射液与间羟胺（阿拉明）、多巴胺等升压药同用，不但能加强升压作用，还能减少对升压药的依赖性。用生脉散、丹参注射液与莨菪碱合用，治疗病态窦房结综合征，既可适度提高心率，又能改善血液循环，从而改善缺血缺氧的状况，达到标本兼治的目的。复方丹参注射液联合门冬氨酸钾注射液治疗慢性重度肝炎，患者症状体征明显改善，肝功能恢复速率提高，治愈时间缩短，提高了临床治愈率。甘草与呋喃唑酮联用治疗肾盂肾炎（A错）属于中西药联用降低毒副作用。以甘草与呋喃唑酮合用治疗肾盂肾炎，既可防止呋喃唑酮的胃肠道反应，又可保留其杀菌作用。柴胡桂枝汤与苯妥英钠联用治疗癫痫（E错）联用的特点，2022年考试指南未明确说明。